痰饮的治疗原则是
A. 宣肺
B. 健脾
C. 温化
D. 补肾
E. 发汗

正确答案：C。温化

解析：痰饮为各种病因所致的肺脾肾气化功能失调，三焦水道不利，水液失于正常运化、输布，停积为痰饮。肺脾肾气化失调，阳气不足为饮邪发生的病理基础，且饮为阴邪，遇寒则凝，得温则行，故治疗当以温阳化饮为基本治疗原则，以振奋阳气，开发腠理，通行水道，故痰饮的治疗原则为温化（C对）。宣肺、健脾、补肾治法单一，仅适用于痰饮单一证候的治疗（ABD错）。痰饮在表者，当温散发汗，但不能作为痰饮总的治疗原则（E错）。